治疗哮证之脾虚证，应首选
A. 射干麻黄汤
B. 定喘汤
C. 玉屏风散
D. 六君子汤
E. 七味都气丸

正确答案：D。六君子汤

解析：六君子汤功能健脾益气，补土生金为哮病缓解期之肺脾气虚证（D对）。射干麻黄汤功能温肺化饮，止哮平喘，为哮病冷哮证的选方（A错）。定喘汤功能清热宣肺，化痰平喘为哮病热哮证的选方（B错）。玉屏风散功能益气固表止汗，为治疗气虚感冒伴有表虚自汗者的选方（C错）。七味都气丸功能补肾纳气，涩精止遗，主治肾虚不能纳气之喘促（E错）。